第一反抗期是在
A. 婴儿期
B. 幼儿期
C. 新生儿期
D. 学龄期
E. 乳儿期

正确答案：B。幼儿期

解析：幼儿期：3岁到6～7岁的儿童处于幼儿期。7～8岁的儿童脑重已接近1300克。因此，7～8岁前是智力发展的关键期。语汇量和语法结构发生了质变。思维出现了简单的逻辑思维和判断推理，模仿力极强，并出现了独立的愿望，开始自行其是，称为“第一反抗期”。掌握“不同年龄阶段心理卫生”知识点。